在感染性休克的治疗中，下列哪项是错误的
A. 处理感染灶，应用有效抗生素
B. 纠正酸中毒
C. 补充血容量
D. 应用大量皮质类固醇
E. 补充钾盐纠正低血钾

正确答案：E。补充钾盐纠正低血钾

解析：感染性休克的治疗原则有以下几点：①补充血容量首先以输注平衡盐溶液为主；②控制感染，主要措施为应用抗菌药物和处理原发感染灶；③纠正酸碱平衡，感染性休克常伴严重的酸中毒，需及时纠正，可应用5%碳酸氢钠静脉滴注；④心血管活性药物的应用，可以采用血管扩张药物治疗和应用改善心功能药物；⑤应用糖皮质激素抑制炎症；⑥全身的营养支持等。掌握“休克”知识点。